取粉末置白纸上，用火隔纸烘烤则熔化，但无扩散的油迹，对光照视呈鲜艳的红色，以火燃烧则产生呛鼻烟气的药材是
A. 没药
B. 五倍子
C. 青黛
D. 儿茶
E. 血竭

正确答案：E。血竭

解析：本题考查的是血竭的理化鉴别。取粉末置白纸上，用火隔纸烘烤则熔化，但无扩散的油迹，对光照视呈鲜艳的红色，以火燃烧则产生呛鼻烟气的药材是血竭（E对）。血竭【理化鉴别】取本品粉末置白纸上，用火隔纸烘烤即熔化，应无扩散的油迹，对光照视呈鲜艳的血红色。以火燃烧则产生呛鼻烟气。没药（A错）【理化鉴别】取本品与水共研形成黄棕色乳状液。粉末遇硝酸呈紫色。五倍子（B错）【理化鉴别】取粉末0.5g，加甲醇5mL，超声处理15分钟，滤过，滤液作为供试品溶液。另取五倍子对照药材0.5g，同法制备对照药材溶液。再取没食子酸对照品，加甲醇制成每1mL含1mg的溶液，作为对照品溶液。吸取上述三种溶液各2μL，分别点于同一硅胶GF₂₅₄薄层板上，以三氯甲烷-甲酸乙酯-甲酸（5∶5∶1）为展开剂，展开，取出，晾干。置紫外光灯（254nm）下观察。供试品色谱中，在与对照药材和对照品色谱相应的位置上，显相同颜色的斑点。青黛（C错）【理化鉴别】①取本品少量，用微火灼烧，有紫红色烟雾产生。②取本品少量，滴加硝酸，产生气泡，并显棕红色或黄棕色。儿茶（D错）【理化鉴别】取火柴杆浸于本品水浸液中，使轻微着色，待干燥后，再浸入盐酸中立即取出，置火焰附近烘烤，杆上即显深红色。